患者，男，48岁。肩背皮肤浅层肿块，与皮肤粘连，瘤体表面中心有黑色粗大毛孔，挤压时有臭味脂浆溢出。其诊断是
A. 脂瘤
B. 肉瘤
C. 流痰
D. 血瘤
E. 筋瘤

正确答案：A。脂瘤

解析：该患者肩背的肿块具有黑色粗大毛孔，挤压时有臭味脂浆溢出，符合脂瘤的独有特征（A对）。肉瘤是由脂肪组织增生而形成的肿瘤，其特点是软似绵，肿似馒，皮色不变，不紧不宽，如肉之隆起（B错）。流痰是发生于骨与关节的疾病，可在病变附近或较远的空隙处形成脓肿，破溃后脓液稀薄如痰（C错）。血瘤是体表血络扩张，纵横丛集而形成的一种肿瘤（D错）。筋瘤是体表静脉曲张交错而形成团块状的一种病变，临床上主要见于严重的下肢静脉曲张所形成的团块（E错）。